城市社区健康教育的基本内容有
A. 城市社区常见疾病防治的宣传教育
B. 家庭健康教育
C. 创建健康城市（国家卫生城市）的宣传与动员
D. 社会卫生公德与卫生法规教育
E. 以上都是

正确答案：E。以上都是